普通型流脑的典型临床表现是
A. 低热头痛皮肤黏膜瘀点
B. 高热循环衰竭皮肤黏膜大片瘀斑
C. 高热皮肤黏膜瘀斑昏迷呼吸衰竭
D. 高热头痛皮肤黏膜瘀斑脑膜刺激征
E. 间歇性发热反复皮肤瘀点血培养可阳性

正确答案：D。高热头痛皮肤黏膜瘀斑脑膜刺激征

解析：流行性脑脊髓膜炎简称为流脑，是由脑膜炎奈瑟菌引起的急性化脓性脑膜炎。其主要临床表现是突发高热、剧烈头痛、频繁呕吐，皮肤黏膜瘀点、瘀斑及脑膜刺激征（D对），严重者可有败血症休克和脑实质损害，常可危及生命。部分患者暴发起病，可迅速致死。本病经呼吸道传播，冬春季多见。全球分布，呈散发或流行，儿童发病率高。